具有凝滞收引致病特点的邪气是
A. 燥邪
B. 火邪
C. 风邪
D. 寒邪
E. 暑邪

正确答案：D。寒邪

解析：寒为阴邪，易伤阳气，其性凝滞主痛，性收引；寒性凝滞是指寒邪伤人，易使气血津液凝结、经脉阻滞（D对）。燥性干涩，易伤津液，燥易伤肺（A错）。火热为阳邪，其性炎上，易扰神，易伤津耗气，易生风动血，易致疮痈（B错）。风为阳邪，轻扬开泄，易袭阳位，其性善行而数变，风性主动，为百病之长（C错）。暑为阳邪，其性炎热，其性升散，易扰心神，伤津耗气，多挟湿（E错）。